皮肤创口缝合后过度外翻是因为
A. 进针点距创缘过远
B. 两侧进针深度不一致
C. 皮肤切口两侧进针间距大于皮下间距
D. 皮肤切口两侧进针间距小于皮下间距
E. 打结过紧

正确答案：D。皮肤切口两侧进针间距小于皮下间距

解析：本题考查缝合。皮肤创口缝合后过度外翻是因为皮肤切口两侧进针间距小于皮下间距（D对）。进针点距创缘过远（A错）会造成创缘接触贴合不紧密而出现裂隙，不会造成皮肤创口缝合后过度外翻。两侧进针深度不一致，可出现无效腔，影响创口愈合，且易导致创口感染（B错）。皮肤切口两侧进针间距大于皮下间距（C错），易造成皮肤创缘内卷。打结过紧（E错）会压迫创缘，影响血供，导致边缘坏死和术后遗留缝线压迹，而且可造成组织撕裂。